香烟烟雾的化学物质中能够使人体产生成瘾作用的是
A. 尼古丁
B. 焦油
C. 致癌物
D. 烟尘
E. 一氧化碳

正确答案：A。尼古丁